下颌神经前干中感觉神经是
A. 咬肌神经
B. 翼内肌神经
C. 颞深神经
D. 翼外肌神经
E. 颊神经

正确答案：E。颊神经

解析：下颌神经前干大部分为运动神经（支配咀嚼肌的颞深神经、咬肌神经核翼外肌神经），前干中唯一的感觉神经为颊神经。掌握“三叉神经的分支与分布”知识点。